患儿男，8个月。近1个月面色苍白。患儿系34周早产，生后母乳喂养，未加辅食。查体：皮肤黏膜苍白，心前区可闻及Ⅱ级收缩期吹风样杂音。肝肋下3cm，脾肋下1cm。红细胞3.0x10¹²/L，血红蛋白71g/L。外周血涂片示红细胞形态大小不等，以小细胞为主，中央变淡。该患儿发病的原因主要为
A. 未及时添加含维生素B₁₂较多的辅食
B. 骨髓造血功能低下
C. 红细胞破坏增多
D. 未及时添加含铁较多的辅食
E. 珠蛋白基因的缺失或点突变

正确答案：D。未及时添加含铁较多的辅食

解析：本题考查营养性缺铁性贫血的病因。该患儿除因早产铁储存不足外，未及时添加铁含量丰富的辅食（D对）是发病重要原因。未及时添加含维生素B₁₂较多的辅食（A错）为营养性巨细胞性贫血的病因。骨髓造血功能低下（B错）为再生障碍性贫血的病因。红细胞破坏增多（C错）为溶血性贫血的病因。珠蛋白基因的缺失或点突变（E错）为珠蛋白生成障碍性贫血的病因。